弧形骨吸收常见于
A. 下前牙
B. 第一磨牙
C. 尖牙
D. 前磨牙
E. 上前牙

正确答案：B。第一磨牙

解析：本题考查侵袭性牙周炎。弧形骨吸收为局限型侵袭性牙周炎牙槽骨破坏的典型特征，以第一磨牙（B对）和切牙区较常见。